小儿疱疹性咽峡炎的病原体是
A. 柯萨奇病毒
B. 鼻病毒
C. 腺病毒
D. 金黄色葡萄球菌
E. 流感嗜血杆菌

正确答案：A。柯萨奇病毒

解析：小儿疱疹性咽峡炎的病原体是柯萨奇病毒（A对）。鼻病毒（B错）和腺病毒（C错）是上呼吸道感染常见的病原体。金黄色葡萄球菌（D错）和流感嗜血杆菌（E错）是肺炎常见的病原体。